《献血法》规定，国家提倡健康公民自愿献血的年龄是
A. 18周岁至40周岁
B. 18周岁至45周岁
C. 18周岁至50周岁
D. 18周岁至55周岁
E. 18周岁至60周岁

正确答案：D。18周岁至55周岁

解析：本题考查《献血法》。《献血法》规定，国家提倡健康公民自愿献血的年龄是18周岁至55周岁（D对ABCE错）。根据《献血者健康检查要求》，既往无献血反应、符合健康检查要求的多次献血者主动要求再次献血的，年龄可延长至60周岁。我国提倡的自愿献血年龄的上限，比国际上的普遍规定低。世界卫生组织提倡的献血年龄是18～65周岁。